患者男，58岁。突然出现左腰部疼痛，剧痛难忍，且向下腹部放射，伴有血尿。查体：左肾区叩击痛阳性。应首先考虑的诊断是
A. 石淋
B. 肠结
C. 精浊
D. 子痈
E. 癃闭

正确答案：A。石淋

解析：泌尿系结石属于“石淋”范畴，分为肾结石、输尿管结石、膀胱结石、尿道结石，患者，男，58岁（本病多发生于青壮年，多数病人在20～50岁之间，男多于女，上尿路结石男女之比约为3:1），患者突然出现左腰部疼痛，剧痛难忍（肾绞痛、腹部钝痛），且向下腹部放射（放射痛），伴有血尿（常继发于肾绞痛之后）。查体：左肾区叩击痛阳性，诊断为肾脏结石（A对）。肠梗阻是以肠内容物不能正常顺利通过肠道为特征的疾病。痛、呕、胀、闭是各类肠梗阻共同的四大症状。属中医“肠结”的范畴（B错）。近前列腺炎当属中医“精浊”范畴，是指前列腺受到致病菌感染和（或）某些非感染性因素刺激而出现的一种以会阴、小腹坠胀，尿频、尿急、尿痛、排尿不适为主要表现的泌尿外科的常见疾病，多发于中青年（C错）。“子痈”属于睾丸炎范畴，急性非特异性睾丸炎多发于单侧。睾丸肿痛，程度由轻微不适到剧烈疼痛不等，向腹股沟放射，阴囊皮肤发红、肿胀。伴寒战、高热、恶心呕吐等。可有头痛，肌肉酸痛。2.慢性非特异性睾丸炎可由急性迁延而来，也可无急性期。因长期轻度感染而形成，临床表现为局部不适，睾丸呈均匀轻度增大，发硬与皮肤不粘连，输精管正常或稍发硬。局部体检：睾丸呈慢性肿大，质硬而表面光滑，有轻触痛，失去正常的敏感度。有的睾丸逐渐萎缩，严重者几乎找不到睾丸，显示附睾相对增大，多数病例炎症由附睾蔓延至睾丸，二者界限不清（D错）。前列腺增生当属中医“癃闭”范畴，男性50岁后出现进行性尿频、排尿困难，应当考虑前列腺增生的可能。诊断要点：有的患者可出现充溢性尿失禁、急性尿潴留、血尿。老年患者虽无明显排尿困难，但有膀胱结石、膀胱炎、肾功能不全时，也应注意有无前列腺增生。结合直肠指检及其他体征、各项实验室检查可得出诊断（E错）。